能补血调经止血的中成药是
A. 妇康宁片
B. 痛经灵颗粒
C. 妇科得生丸
D. 加味逍遥丸
E. 妇康宝口服液

正确答案：E。妇康宝口服液